关于胸膜的描述，正确的是
A. 肋胸膜与脏胸膜之间的返折线是胸膜前界
B. 左，右两侧胸膜前界均起自胸膜顶，垂直下行至第六胸肋关节处移行于胸膜下界
C. 胸膜下界在腋中线相交于第8肋
D. 脏胸膜跨过肺裂，包被肺叶，与肺质紧密结合在一起
E. 以上全不对

正确答案：D。脏胸膜跨过肺裂，包被肺叶，与肺质紧密结合在一起

解析：脏胸膜跨过肺裂，包被肺叶，与肺质紧密结合在一起（D对）。肋胸膜与纵隔胸膜前缘的返折线是胸膜前界（A错）。胸膜前界上端起于胸膜顶，向内下斜行，右侧的胸膜下界前内侧端起自第6胸肋关节的后方，左侧的胸膜下界内侧端起自第6肋软骨后方（B错）。胸膜下界在腋中线相交于第10肋（C错）。